统计推断的两个方面为
A. 点估计与区间估计
B. 参数估计与假设检验
C. 统计图表与假设检验
D. 统计图表与参数估计
E. 统计预测与统计控制

正确答案：B。参数估计与假设检验

解析：本题考查统计推断的相关内容。统计推断最常用的两种统计推断方法：置信区间估计和假设检验（B对ACDE错）。